病侧呼吸动度减弱伴叩诊为浊音、呼吸音消失者，见于
A. 肺实变
B. 肺气肿
C. 肺不张
D. 气胸
E. 胸膜增厚

正确答案：C。肺不张

解析：阻塞性肺不张患侧呼吸动度减弱或消失，气管移向患侧，语颤减弱或消失，叩诊患侧呈浊音或实音，听诊呼吸音消失，听觉语音减弱或消失（C对）。肺实变患侧呼吸动度局限性减弱或消失，叩诊为实音，呼吸音消失，可听到病理性支气管呼吸音，支气管语音增强（A错）。肺气肿胸廓成桶状，两侧呼吸动度减弱，叩诊两肺过清音，严重者心界叩不出，肺下界下降，肺下界移动度减弱，两肺肺泡呼吸音减弱，呼吸延长，听觉语音减弱，心音较遥远（B错）。气胸患侧胸廓饱满，肋间隙增宽，呼吸动度减弱或消失，叩诊患侧呈鼓音，左侧气胸是心界叩不出，右侧气胸时肝浊音界下移，患侧呼吸音减弱或消失（D错）。胸膜增厚视诊患侧呼吸运动减弱或消失，患侧胸廓塌陷，叩诊患侧叩诊浊音，心界向患侧移位，听诊呼吸音减弱而语音减弱或消失（E错）。